主要见于肾盂肾炎的管型是
A. 红细胞管型
B. 白细胞管型
C. 上皮细胞管型
D. 透明管型
E. 蜡样管型

正确答案：B。白细胞管型

解析：主要见于肾盂肾炎的管型是白细胞管型（B对）。红细胞管型临床意义与血尿相似，见于泌尿系炎症、结石、肿瘤、结核、外伤等患者尿液中（A错）。上皮细胞管型在肾小管损伤时出现（C错）。透明管型可见于正常人尿中、肾病综合征、慢性肾炎等患者尿液中（D错）。蜡样管型提示有严重的肾小管变性坏死，且预后不良（E错）。